患者，男，13岁，身体健康，牙龈增生影响咀嚼多年。检查见全口牙龈增生。覆盖牙面2/3以上，质地坚实，其父亲有同样的病史，应诊断为
A. 药物性牙龈增生
B. 增生性龈炎
C. 牙龈纤维瘤病
D. 青春期龈炎
E. 白血病

正确答案：C。牙龈纤维瘤病

解析：本题考查牙龈纤维瘤病的诊断。患者身体健康，牙龈增生多年。全口牙龈增生。覆盖牙面2/3以上，质地坚实，有家族史，综合考虑应诊断为牙龈纤维瘤病（C对）。本病可在幼儿时就发病，最早可发生在乳牙萌出后，一般开始于恒牙萌出之后，牙龈广泛地逐渐增生，可累及全口的龈缘、龈乳头和附着龈，甚至达膜龈联合处，以上颌磨牙腭侧最为严重。药物性牙龈增生（A错）有服药史而无家族史，牙龈增生主要累及龈缘和龈乳头，一般不波及附着龈。增生性龈炎（B错）增生程度相对较轻，覆盖牙冠一般不超过1/3，多数伴有炎症，局部刺激因素明显，无长期服药史及家族史。青春期龈炎（D错）龈乳头常呈球状突起，颜色暗红或鲜红，光亮，质地软，探诊出血明显。与本病例的临床表现不符合。白血病（E错）的牙龈病损表现为牙龈肿大，颜色暗红发绀或苍白，组织松软脆弱或中等硬度，表面光亮，牙龈有明显出血倾向。与本病例的临床表现不符合。